突触后电位包括兴奋性突触后电位和抑制性突触后电位。关于突触后电位的特征，下列哪项是错误的
A. 电位大小随刺激的强度改变
B. 有时间总和
C. 有空间总和
D. 是“全或无"的
E. 以电紧张方式扩布

正确答案：D。是“全或无"的